下列选项中属于口腔一级预防的是
A. 义齿修复
B. 充填治疗
C. 窝沟封闭
D. 牙周深刮
E. 正畸矫治

正确答案：C。窝沟封闭

解析：本题考查分级预防。下列选项中属于口腔一级预防的是窝沟封闭（C对）。1.一级预防是针对病因的预防措施，是疾病发生前的预防。消除致病因素，防止对人体的危害是一级预防的主要任务。如自我口腔保健、口腔健康教育、氟化物和窝沟封闭剂的使用、刷牙漱口、控制菌斑等。2.二级预防是针对疾病早期的预防措施，即在疾病发生的前期做到早期诊断和早期治疗。如早期龋病充填、牙龈炎治疗等。3.三级预防是针对疾病处于中后期时的预防措施，通过有效的治疗措施，防止病情恶化，预防并发症和后遗症，尽量恢复或保留口腔功能，如牙列缺损和缺失的修复等。